卫生行政部门应当自收到医疗事故争议处理申请之日起几日内进行审查
A. 5日
B. 7日
C. 10日
D. 12日
E. 14日

正确答案：C。10日

解析：卫生行政部门应当自收到医疗事故争议处理申请之日起10日内进行审查，作出是否受理的决定。故正确选项是C。掌握“医疗事故行政处理、监督与法律责任”知识点。